毛果芸香碱是
A. α受体激动药
B. β受体激动药
C. α、β受体激动药
D. M受体激动药
E. N受体激动药

正确答案：D。M受体激动药

解析：本题考查毛果芸香碱。毛果芸香碱是M受体激动药（D对），能够选择性兴奋M胆碱受体，发挥M样作用。